患者女，60岁慢性支气管炎合并肺气肿病史20年，一周来病情加重，咳嗽，心悸，气喘，夜间不能平卧血气分析：PaO₂50mmHg，PH7.30改善缺氧，首选的治疗措施是
A. 机械通气
B. 给予呼吸兴奋剂
C. 持续高浓度给氧
D. 持续低浓度给氧
E. 不需要给氧

正确答案：D。持续低浓度给氧

解析：持续低浓度给氧可以有效改善患者缺氧情况减少因为气道阻塞引起的各类并发症（D对E错）。机械通气适用于脑部外伤、感染、脑血管意外及中毒等所致中枢性呼吸衰竭；支气管、肺部疾患所致周围性呼吸衰竭；呼吸肌无力或麻痹状态；胸部外伤或肺部、心脏手术；心肺复苏等（A错）。呼吸兴奋剂的使用原则；必须保持气道通畅，否则会促发呼吸肌疲劳，进而加重CO₂潴留（B错）。吸入气氧浓度在60%以上的氧疗方法。主要应用于重度低氧血症而无二氧化碳潴留的患者。可能会导致氧中毒，不宜长期应用（C错）。